治疗癫痫失神发作的首选药品是
A. 地西泮
B. 加巴喷丁
C. 苯妥英钠
D. 卡巴西平
E. 丙戊酸钠

正确答案：E。丙戊酸钠

解析：本题考查抗癫痫药。丙戊酸钠（E对）是治疗癫痫失神发作、原发性全面性发作、强直阵挛发作、肌阵挛强直、失张力发作、部分性发作的首选药品。地西泮（A错）为治疗癫痫持续状态的首选。加巴喷丁（B错）用于成人和12岁以上儿童伴或不伴癫痫继发性全身发作的部分性发作的辅助治疗。苯妥英钠（C错）用于治疗强直阵挛性发作、部分性发作以及癫痫持续状态。卡马西平（D错）用于治疗强直阵挛性发作以及部分性发作。